又称为拟核的是
A. 核质
B. 中介体
C. 肽聚糖
D. 核糖体
E. 异染颗粒

正确答案：A。核质

解析：核质是由细胞质内的细菌本身的遗传物质DNA和RNA聚集而成，因为无核膜，不具备完整的核结构，故亦称为拟核。掌握“细菌的大小、形态和基本结构”知识点。